慢性肾功能衰竭的分期中不包括哪期?
A. 肾功能不全期
B. 肾功能代偿期
C. 肾功能衰竭期
D. 肾功能恢复期
E. 尿毒症期

正确答案：D。肾功能恢复期

解析：慢性肾功能衰竭根据肾功能变化和内环境紊乱程度，可分为以下四期：1.肾储备功能降低期（代偿期）（B对）；2.肾功能不全期（A对）；3.肾功能衰竭期（C对）；4.尿毒症期（E对），不包括肾功能恢复期（D错，为本题正确答案）。